寿命表中所含有的指标可不包括
A. 年龄
B. 年龄组死亡概率
C. 尚存人数
D. 生存人年数
E. 总死亡率

正确答案：E。总死亡率

解析：本题考查寿命表中含有的指标。寿命表中所含有的指标包括：年龄组（A对）、年龄组死亡概率（B对）、生存概率、尚存人数（C对）、死亡人数、生存人年数（D对）、生存总人年数、期望寿命等。寿命表中所含有的指标可不包括总死亡率（E错，为本题正确答案）。